主动脉瓣关闭不全时，左心室扩大，心影外形应是
A. 梨形
B. 靴形
C. 里横位
D. 烧瓶形
E. 心腰部突出

正确答案：B。靴形

解析：主动脉瓣关闭不全时，左心室扩大，心影外形应是靴形（B对）。梨形（A错）心可见于二尖瓣狭窄引起的左心房增大或合并肺动脉段扩大。烧瓶心（D错）可见于心包积液。心腰部突出（E错）可见于主动脉高压。